前牙也可有暂时性深覆（牙合）现象，随着恒牙的继续萌出，以及颌骨的生长
A. 上唇系带位置过低
B. 中切牙间间隙
C. 暂时性远中（牙合）
D. 暂时性前牙拥挤
E. 暂时性深覆（牙合）

正确答案：E。暂时性深覆（牙合）

解析：暂时性深覆（牙合）：前牙也可有暂时性深覆（牙合）现象，随着恒牙的继续萌出，以及颌骨的生长。前牙的深覆（牙合）可逐渐成为正常覆（牙合）。掌握“（牙合）的生长发育”知识点。